男孩，4岁。发热、头痛、皮疹12小时，频繁抽搐、昏迷2小时。查体：全身可见大淤点淤斑，双下肢右部分融合成片，血压测不出，右侧瞳孔散大，对光反射消失。下列处理不正确的是
A. 吸氧及心电监护
B. 淤点涂片检菌
C. 立刻腰椎穿刺做脑脊液常规检查
D. 20%甘露醇立即静脉滴注
E. 急查DIC指标

正确答案：C。立刻腰椎穿刺做脑脊液常规检查

解析：4岁男性儿童，出现发热、头痛、全身皮肤可见散在的瘀点、瘀斑，伴频繁惊厥、昏迷，伴脑疝（突发意识障碍，右侧瞳孔散大，对光反应消失），应考虑为细菌性脑膜炎可能性大。此时明显存在颅内压增高的表现，若在未有效降低颅内压之前行腰椎穿刺，有加重脑疝的危险（C错，为本题正确答案）。建议在条件允许的情况下，先做头颅影像学检查，如果条件不允许，应该先静脉输注甘露醇降颅压（D对），再谨慎地进行腰椎穿刺。其余治疗均为对症支持治疗和必要检查，无不妥之处（ABE对）。